患者男，74岁，服药后出现血清丁－谷氨酰转移酶（-GT）升高，最可能造成此不良反应的药物是
A. 葡醛内酯
B. 苯妥英钠
C. 联苯双酯
D. 门冬氨酸钾镁
E. 水飞蓟宾

正确答案：B。苯妥英钠